29岁孕妇，妊娠32周，3周内阴道少量流血2次，今凌晨突然阴道流血多于月经量，无腹痛，血压13.3/10.7kPa，脉率96次/分，宫高30cm，腹围85cm，臀先露，未入盆，胎心音清楚，144次/分以下辅助检查中应首选哪一项对确定诊断意义最大
A. 血常规
B. 血小板测定
C. B超
D. X线摄片
E. 阴道检查

正确答案：C。B超

解析：超声检查B型超声断层显像可清楚看到子宫壁、胎先露部、胎盘和宫颈的位置，并根据胎盘边缘与宫颈内口的关系进一步明确前置胎盘的类型。掌握“前置胎盘”知识点。